在绝大多数人中
A. 胆囊管汇合于右肝管
B. 胆囊管汇合于肝总管
C. 胆囊管汇合于左肝管
D. 胆囊管汇合于乏特氏壶腹部
E. 胆囊管汇合于十二指肠球后部胆总管

正确答案：B。胆囊管汇合于肝总管

解析：左右肝管出肝后，在肝门部汇合形成肝总管，肝总管与胆囊管汇合形成胆总管（B对）。胆总管与主胰管汇合开口于十二指肠降部壁内段即乏特氏壶腹（D错），有时肝总管前方有肝固有动脉发出的肝右动脉或胆囊动脉越过，6%～10%的人有副肝管，1.4%的人可以无肝总管。